鉴别磺胺甲噁唑依据的反应是
A. 芳香第一胺的反应
B. 丙二酰脲的反应
C. 绿奎宁反应
D. 托烷生物碱的反应
E. 与二氯靛酚钠的反应

正确答案：A。芳香第一胺的反应

解析：本题考查常用的药品鉴别方法。鉴别磺胺甲噁唑依据的反应是芳香第一胺的反应（A对）。磺胺甲噁唑具有芳伯氨基，在酸性溶液中可与亚硝酸钠作用生成重氮盐；重氮盐遇碱性β-萘酚发生偶合反应，生成橙黄色至猩红色沉淀。中国药典规定采用芳香第一胺反应鉴别此类药物。丙二酰脲反应（B错）常用于鉴别巴比妥类药物。绿奎宁反应（C错）用于6-氧喹啉衍生物的鉴别。托烷生物碱反应（D错）又称Vitali反应，是托烷类生物碱药物如阿托品的专属鉴别反应。二氯靛酚钠反应（E错）常用于鉴别维生素C。